对牙周生态系正常菌群描述哪项是错误的
A. 稳定不变的
B. 相对的
C. 动态的
D. 群体优势在消长和波动
E. 有条件的

正确答案：A。稳定不变的

解析：本题考查牙周生态系正常菌群。正常菌群对维持口腔健康很重要，但正常菌群不是固定不变的（A错，为本题的正确答案），各种微生物群体的优势在消长和波动（D对），口腔正常菌群是相对的（B对）、动态的（C对）、可变的和有条件的（E对），一旦菌群失调，便会危害口腔健康。